最理想的冠桩外形是
A. 近似槽柱形
B. 光滑柱形
C. 螺纹形
D. 近似圆锥形
E. 弯制冠桩形

正确答案：D。近似圆锥形

解析：本题考查桩的形状与表面结构。桩核冠的冠桩呈近似圆锥形（D对）时，桩冠的密和度好，并且有良好的就位与粘固，从而有良好的固位力，故是理想的冠桩外形。桩核冠的冠桩呈近似槽柱状（A错）时，多余粘结剂不易溢出，桩冠就位困难，易导致牙折。桩核冠的冠桩呈光滑柱形（B错）时，患牙的根壁厚度不能做到在桩的全长范围内各个层面上保持均匀一致，易致牙根受力不均折断。桩核冠的冠桩呈螺纹状（C错）时，桩冠就位会对根管壁产生应力。桩核冠的冠桩为弯制冠桩形（E错），则冠桩过细，不仅固位力不足，而且受力时桩易产生弯曲或折断。